患儿，男，1岁，既往难产史。头颈部左偏，面向左侧，颈向右侧，导致该现象的肌肉是
A. 前斜角肌
B. 后斜角肌
C. 胸锁乳突肌
D. 颈阔肌
E. 斜方肌

正确答案：C。胸锁乳突肌

解析：该患儿，男，1岁，既往难产史。出现头颈部左偏，面向左侧，颈向右侧，结合患儿的表现，提示胸锁乳突肌受损（C对）。前斜角肌、后斜角肌的主要作用使颈侧屈或前屈；上提第1、2肋助吸气（AB错）。颈阔肌的主要作用拉口角及下颌向下（D错）。斜方肌的主要作用拉肩胛骨向脊柱靠拢；如果肩胛骨固定，作用同胸锁乳突肌（E错）。